可用于固体分散体制备的方法是
A. 饱和水溶液法
B. 复凝聚法
C. 熔融法
D. X射线衍射法
E. 热分析法

正确答案：C。熔融法